最常用于确诊流行性脑脊髓膜炎的方法是
A. 血培养
B. 脑脊液培养
C. 瘀点挤液涂片染色镜检
D. 特异性抗体检测
E. 骨髓培养

正确答案：C。瘀点挤液涂片染色镜检

解析：流行性脑脊髓膜炎是由脑膜炎球菌引起的急性化脓性脑膜炎，大多数患者，发病数小时后全身皮肤、黏膜出现瘀点局部消毒后，用针尖挑破皮肤上瘀点，挤出少量组织液涂片，以革兰染色，可见脑膜炎球菌，阳性率达80%以上，是早期诊断依据之一，因此最常用于确诊流行性脑脊髓膜炎的方法是瘀点挤液涂片染色镜检（C对）。